肝主疏泄，调畅全身气机功能，具体体现在
A. 调畅情志
B. 协调脾升胃降
C. 促进津液代谢
D. 调畅排精行经
E. 生成血液

正确答案：A、B、C、D。调畅情志；协调脾升胃降；促进津液代谢；调畅排精行经

解析：本题考查肝藏象的功能。肝的功能包括：调畅情志（A对）、协调脾胃升降（B对）、促进血液运行和津液代谢（C对）、调畅排精行经（D对）。肝的生理功能主要有两方面一是主疏泄，二是藏血。肝主疏泄肝主疏泄，是指肝气具有疏通、畅达全身气机，进而调畅精血津液的运行输布、脾胃之气的升降、胆汁的分泌排泄以及情志活动等作用。肝的疏泄功能反映了肝为刚脏、主升、主动的生理特点，中心环节是调畅全身气机。肝主疏泄，调畅全身气机功能，具体体现在五个方面：（1）调畅情志（2）协调脾胃升降（3）促进胆汁生成与排泄（4）促进血液运行和津液代谢（5）调畅排精行经。心主血，肾藏精，血化为精，精能生血（E错），这种精血互生关系，体现了心肾之间的相关性。